小儿惊风的特征性证候为
A. 抽搐神清
B. 高热抽搐伴神昏
C. 四肢抽搐，口吐涎沫
D. 四肢抽搐或作猪羊叫
E. 突然仆倒，昏不知人

正确答案：B。高热抽搐伴神昏

解析：惊风是小儿时期常见的一种以抽搐、神昏为特征的证候，分为急惊风和慢惊风，急惊风来势急骤，临床以高热伴抽搐、昏迷为特征；慢惊风来势缓慢，抽搐无力，时作时止，反复难愈，常伴昏迷，瘫痪等症，根据最佳选项的原则，选项高热抽搐伴神昏更为合适（B对）。抽搐神清（A错）可见于维生素D缺乏性手足搐搦症或癫痫（部分发作）。四肢抽搐，口吐涎沫（C错）和四肢抽搐或作猪羊叫（D错）可见于癫痫。突然仆倒，昏不知人（E错）可见于厥证、脱水、低血糖等症。